最能反映组织中毒性缺氧的指标是：
A. PaO2↓
B. A血氧容量↓
C. A血氧含量↓
D. A-V血氧含量差↑
E. V血氧含量↑

正确答案：E。V血氧含量↑

解析：组织性缺氧时动脉血氧分压（A错）、血氧含量（C错）、血氧容量（B错）和血氧饱和度均正常，而V(静脉)血氧分压、血氧含量（E对）和血氧饱和度都高于正常，动－静脉血氧含量差减小（D错）。